卵巢排出的卵子受精部位在
A. 输卵管伞端和壶腹部
B. 输卵管壶腹部
C. 输卵管峡部
D. 壶腹部与峡部连接处
E. 输卵管伞端

正确答案：D。壶腹部与峡部连接处

解析：卵巢排出的卵子（次级卵母细胞）在输卵管壶腹部与峡部连接处与精子结合，其过程称为受精。掌握“妊娠生理”知识点。